青春期晚期不包括
A. 性腺基本发育成熟
B. 出现月经初潮或首次遗精
C. 第二性征发育成熟
D. 骨骼基本愈合
E. 体格发育基本停止

正确答案：B。出现月经初潮或首次遗精

解析：本题考查青春期的分期特点。青春中期，则以性器官和第二性征迅速发育为主要特征，出现月经初潮和首次遗精（B错，为本题正确答案）。青春晚期，则性腺基本发育成熟（A对），第二性征发育成熟（C对），骨骼基本愈合（D对），体格发育基本停止生长（E对）。